按照药性升降浮沉理论，具有升浮药性的药是
A. 重镇安神药
B. 平肝息风药
C. 开窍药
D. 利水药
E. 泻下药

正确答案：C。开窍药

解析：升浮药，其性属温热，味属辛、甘、淡，质地多为轻清至虚之品，作用趋向多主上升，向外。就其代表药物的功效是而言，分别具有祛风散寒解表、宣毒透疹、温里散寒、行气开郁、开窍醒神、涌吐等作用，故解表药、温里药、行气药、开窍药（C对）、涌吐药等多具有升浮的药性。沉降药，其性属寒凉，味属酸、苦、咸，质地多为重着坚实之品，作用趋向多主下行向内。就其代表药物的功效是而言，分别具有重镇安神、熄风潜阳、平肝潜阳、止咳平喘、渗湿利尿、清热泻下、收敛止血、止呕等作用，故重镇安神药（A错）、平肝息风药（B错）、止咳药、利水药（D错）、泻下药（E错）、止血药等多具有沉降的药性。